属于人工合成的有机粉尘是
A. 铝
B. 石英
C. 炸药
D. 水泥
E. 木材

正确答案：C。炸药